大肠功能失常，可直接导致
A. 肾失气化
B. 肝失疏泄
C. 肺失肃降
D. 脾失健运
E. 脾失升清

正确答案：C。肺失肃降

解析：肺与大肠相表里；肺气清肃下降，能促进大肠的传导，有利于糟粕的排泄；大肠传导正常，糟粕下行，亦有利于肺气的肃降；反之，肺气壅塞，失于肃降，可引起腑气不通，肠燥便秘。若大肠实热，传导不畅，腑气阻滞，也可影响到肺的宣降（C对）。